对鼻旁窦的描述中，错者为
A. 额窦开口于中鼻道
B. 上颌窦位于上颌骨体内
C. 筛窦前、中群开口于中鼻道
D. 各鼻道均有鼻旁窦的开口
E. 无

正确答案：D。各鼻道均有鼻旁窦的开口

解析：额窦开口于中鼻道（A对）。上颌窦位于上颌骨体内（B对）。筛窦前、中群开口于中鼻道（C对）。额窦开口于中鼻道，上颌窦开口于中鼻道的半月裂孔，前、中筛窦开口于中鼻道，后筛窦开口于上鼻道，蝶窦开口于左、右蝶筛隐窝，所以没有鼻旁窦开口于下鼻道（D错，为本题正确答案）。